对苯海索的叙述，哪项是错误的
A. 阻断中枢胆碱受体
B. 对帕金森的疗效不如左旋多巴
C. 对氯丙嗪引起的震颤麻痹无效
D. 对僵直和运动困难疗效差
E. 外周抗胆碱作用比阿托品弱

正确答案：C。对氯丙嗪引起的震颤麻痹无效

解析：可通过拮抗胆碱受体而减弱黑质-纹状体通路中ACh的作用，抗震颤效果好，也能改善运动障碍和肌肉强直；对少数不能接受L-DOPA或多巴胺受体激动药的PD病人，可用本药治疗。氯丙嗪主要拮抗脑内边缘系统的多巴胺受体，也能拮抗肾上腺素α受体和M胆碱受体，因此苯海索与氯丙嗪有协同的作用掌握“左旋多巴、卡比多巴、苯海索”知识点。